下列关于预防甲型肝炎所采取的措施不正确的是
A. 甲肝疫苗能有效预防和控制甲型肝炎的流行
B. 饮食行业和保育人员中的甲型肝炎患者须痊愈后方可恢复工作
C. 人免疫球蛋白可预防甲型肝炎临床型感染
D. 甲型肝炎的预防应采取以切断血液传播途径为主的防治措施
E. 对甲型肝炎患者应早发现、早诊断、早报告、早隔离、早治疗

正确答案：D。甲型肝炎的预防应采取以切断血液传播途径为主的防治措施